胸部叩诊呈实音的是
A. 肺气肿
B. 大量胸腔积液
C. 气胸
D. 支气管肺炎
E. 肺空洞

正确答案：B。大量胸腔积液

解析：肺气肿叩诊呈过清音（A错）。中至大量胸腔积液叩诊浊音或实音（B对）。气胸叩诊呈鼓音（C错）。支气管肺炎叩诊可叩诊呈浊音（D错）。肺空洞叩诊呈鼓音（E错）。